在体内与巯基系统有联系的维生素是
A. 维生素A
B. 维生素B₁
C. 维生素C
D. 维生素D
E. 维生素E

正确答案：C。维生素C